下列指标中，最常用来评价人群健康状况、社会经济发展和人民生活质量的是
A. 无残疾期望寿命
B. 平均期望寿命
C. 无残疾期望寿命
D. 生命质量指数（PQLI）
E. 婴儿死亡率

正确答案：E。婴儿死亡率

解析：本题考查评价人群健康状况、社会经济发展和人民生活质量的指标。婴儿死亡率（E对ABCD错）是指婴儿出生后不满周岁死亡人数同出生人数的比率。常用来评价人群健康状况、社会经济发展和人民生活质量。